血管紧张素Ⅱ受体阻断剂主要药理作用有
A. 抗高血压作用
B. 肝脏保护作用
C. 肾脏保护作用
D. 脑血管保护作用
E. 减轻左室心肌肥厚作用

正确答案：A、C、D、E。抗高血压作用；肾脏保护作用；脑血管保护作用；减轻左室心肌肥厚作用

解析：本题考查血管紧张素Ⅱ受体阻断剂的药理作用。血管紧张素Ⅱ受体阻断剂主要药理作用包括：降压作用（A对）、减轻左心室肥厚（E对）、肾脏保护作用（C对）、脑血管保护作用（D对）。对肝脏没有作用（B错）。